卫生服务系统的需求是指
A. 由需要转化而来的需求和没有需要的利用
B. 由需要转化而来的利用和没有需要的需求
C. 由需要转化而来的需求和没有利用的需求
D. 由需要转化而来的需求和没有需要的需求
E. 由需要转化而来的利用和没有利用的需求

正确答案：D。由需要转化而来的需求和没有需要的需求

解析：本题考查卫生服务系统的需求。卫生服务系统的需求是指由需要转化而来的需求和没有需要的需求（D对）。卫生服务需求是指居民在一定时期内和一定价格水平上，愿意利用而且有支付能力的卫生服务的数量，实际工作中，常用卫生服务利用来表示卫生服务需求，如：门（急）诊人次数，住院人次数，检查人次数。